患者因肺肾阴虚，虚火妄动，脉络受伤而致咳血治疗应首选
A. 孔最
B. 粱丘
C. 隐白
D. 曲泽
E. 定喘

正确答案：A。孔最

解析：孔最穴主治①咯血、咳嗽、气喘、咽喉肿痛等肺系病证②肘臂挛痛”（A对）。梁丘穴主治①急性胃病②膝肿痛、下肢不遂等下肢病证③乳痈乳痛等乳疾”（B错）。隐白穴主治①月经过多、崩漏等妇科病②便血、尿血等慢性出血证③癫狂，多梦④惊风⑤腹满，暴泻”（C错）。曲泽穴主治①心痛、心悸、善惊等心系病证②胃痛、呕血、呕吐等热性胃病③暑热病④肘臂挛痛”（D错）。（P123）定喘穴主治①哮喘，咳嗽②肩背痛，落枕（E错）。